半腱肌和半膜肌
A. 分别起自坐骨结节和股骨后面
B. 止于胫骨粗隆
C. 位于股后内侧部
D. 可屈髋关节，屈膝关节
E. 可使膝关节旋外

正确答案：C。位于股后内侧部

解析：半腱肌和半膜肌起自坐骨结节，而非分别起自坐骨结节和股骨后面（A错），分别止于胫骨上端内侧和胫骨内侧髁后面，而非胫骨粗隆（B错），均位于股后内侧部（C对），可伸髋关节，屈膝关节，而非屈髋关节，屈膝关节（D错），可使膝关节旋内，而非旋外（E错）。